女，26岁。半年来无原因认为同事指桑骂槐地议论她，街上行人的举动及电视内容都针对她。为之心情烦躁，不敢上班。该病人的精神症状最可能是
A. 被害妄想
B. 情感脆弱
C. 影响妄想
D. 关系妄想
E. 焦虑

正确答案：D。关系妄想

解析：关系妄想（D对）患者认为周围环境中所发生均与自己有关。本题患者半年来无原因认为同事指桑骂槐地议论她，街上行人的举动及电视内容都针对她（患者认为周围环境中所发生均与自己有关），最可能的精神症状是关系妄想。被害妄想（A错）患者坚信自己被某些人或某组织进行迫害，如投毒、跟踪、监视、诽谤等。情感脆弱（B错）在外界轻微刺激下甚至不存在明显的外界因素的影响下，病人的情绪很容易发生波动。影响妄想（C错）又称被控制感，患者感到自己的思想、情感或意志行为受到某种外界力量的控制而身不由己。如患者经常描述被红外线、电磁波、超声波或某种特殊的先进仪器控制。焦虑（E错）是指在缺乏相应的客观刺激情况下出现的内心不安状态。